侧舌隆突出现的时间是胚胎
A. 第四周
B. 第五周
C. 第六周
D. 第七周
E. 第八周

正确答案：A。第四周

解析：胎儿发育到第四周，下颌弓的内表面因下方的间充质增生，长出三个膨隆的突起，两侧两个对称的突起体积较大，称侧舌隆突。掌握“腭部与舌的发育”知识点。